通过降低血管壁细胞内钠离子含量，使细胞内钙离子减少的药物是
A. 普萘洛尔
B. 硝苯地平
C. 肼屈嗪
D. 卡托普利
E. 氢氯噻嗪

正确答案：E。氢氯噻嗪